六淫之中只有外感而无内生的邪气是
A. 风
B. 寒
C. 暑
D. 湿
E. 火

正确答案：C。暑

解析：本题考查对外感六淫与内生“五邪”的区别，属于理解记忆内容。六淫，即风、寒、暑、湿、燥、火（热）六种外感病邪的统称。内生“五邪”，是指在疾病的发展过程中，由于脏腑经络及精气血津液的功能失常而产生的化风、化寒、化湿、化燥、化火等病理变化。暑邪有明显的季节性，主要发生于夏至以后，立秋之前，是六淫之中只有外感而无内生的邪气（C对）。风、寒、湿、燥、火（热）邪气既可有外感，又可有内生（ABDE错）。